严重II型呼吸衰竭病人宜低浓度氧疗这是由于
A. PaO₂低于60mmHg(1mHg0.133kPa)对化学感受器作用才明显
B. PaO₂为30mmHg时肺通气量最大
C. PaCO₂超过80mmHg时呼吸运动主要靠低氧刺激
D. 缺氧对呼吸中枢抑制作用大于反射兴奋作用
E. 低浓度氧疗能增强呼吸动力

正确答案：C。PaCO₂超过80mmHg时呼吸运动主要靠低氧刺激

解析：严重II型呼吸衰竭病人宜低浓度氧疗这是由于PaCO₂超过80mmHg时呼吸运动主要靠低氧刺激（C对）。